经空气传播的微生物是
A. 乙肝病毒
B. 单纯疱疹病毒
C. HIV
D. 破伤风杆菌
E. 结核杆菌

正确答案：E。结核杆菌

解析：本题考查微生物的传播途径。经空气传播的微生物是结核杆菌（E对）。经空气传播的主要微生物有：水痘病毒、麻疹病毒、风疹病毒、流行性腮腺炎病毒、流感病毒、结核杆菌、化脓性链球菌等。经接触传播的微生物有：乙肝病毒（A错）、丙肝病毒、丁肝病毒、单纯疱疹病毒Ⅰ型、单纯疱疹病毒Ⅱ型（B对）、人类免疫缺陷病毒（HIV）（C错）、淋病双球菌、梅毒螺旋体、铜绿假单胞菌、金色/白色葡萄球菌、破伤风杆菌（D错）等。